药品检验时，“称定”系指称取重量应准确至所取重量的
A. 十分之一
B. 百分之一
C. 千分之一
D. 万分之一
E. 十万分之一

正确答案：B。百分之一

解析：本题考查中国药典的凡例。药品检验时，“称定”系指称取重量应准确至所取重量的百分之一（B对）。“称定”系指称取重量应准确至所取重量的百分之一。“精密称定”系指称量准确到所取重量的千分之一（C错）。